临床试验
A. 设立对照组
B. 盲法观察
C. 两者均有
D. 两者均无

正确答案：C。两者均有

解析：本题考查临床试验的特点。临床试验是随机对照试验或随机临床试验的简称，强调以病人个体为单位进行试验分组（分为对照组和实验组）和施加干预措施。临床试验的特点为：①以病人为研究对象；②研究多在医院进行；③多为治疗性试验；④研究对象应尽可能在基线特征方面一致；⑤随机分配治疗措施；⑥尽可能采用盲法（C对ABD错）；⑦若对所研究的疾病没有接受的疗法，可以应用安慰剂作为比较。